女，25岁，足月妊娠。因前置胎盘发生DIC，阴道大出血入院。查体：T35℃，P130次/分，R25次/分，BP90/40mmHg。实验室检查：Hb55g/L，血小板20×10^5/L，血纤维蛋白原1.6g/L。不正确的输血处理措施是输注
A. 新鲜冰冻血浆
B. 浓缩血小板
C. 普通冰冻血浆
D. 冷沉淀
E. 悬浮红细胞

正确答案：C。普通冰冻血浆

解析：DIC（九版内科学P623）是在许多疾病的基础上，以微血管体系损伤为病理基础，凝血及纤溶系统被激活，导致全身微血管血栓形成，凝血因子大量消耗并继发纤溶亢进，引起全身出血及微循环衰竭的临床综合征。治疗上可输注浓缩血小板（B对）、新鲜冰冻血浆（A对）（含有全部凝血因子和血浆蛋白）作替代治疗，以补充丢失的血小板及凝血因子。普通冰冻血浆（C错，为本题正确答案）虽也可补充凝血因子、治疗凝血障碍，但其缺乏不稳定凝血因子FⅤ、FⅧ（凝血过程中的关键因子），故不适用于治疗DIC。患者血纤维蛋白原偏低（血浆纤维蛋白原正常值为2～4g/L），可输注冷沉淀（D对）进行补充。冷沉淀为血浆在2～6℃条件下不溶解的部分，主要成分为纤维蛋白原及血管性血友病因子。患者Hb55g/L提示重度贫血（孕妇＜100g/L即为贫血，30～59g/L为重度贫血），应输注悬浮红细胞（E对）进行纠正。